具有留钾作用的利尿药是
A. 甘露醇
B. 去氨加压素
C. 螺内酯
D. 甘油果糖
E. 氢氯噻嗪

正确答案：C。螺内酯

解析：本题考查螺内酯。具有留钾作用的利尿药是螺内酯（C对）。螺内酯为醛固酮的竞争性拮抗剂，可竞争性地与胞浆中的醛固酮受体结合而拮抗醛固酮的保钠排钾作用，促进Na⁺和水的排出，减少K⁺的排出。甘露醇（A错）和甘油果糖（D错）为渗透性利尿药。氢氯噻嗪（E错）为中效利尿药。